硬脂酸镁为中药片剂常用的
A. 崩解剂
B. 润湿剂
C. 吸收剂
D. 黏合剂
E. 润滑剂

正确答案：E。润滑剂

解析：本题考查的是片剂的辅料。硬脂酸镁为中药片剂常用的润滑剂（E对）。硬脂酸镁：为白色细腻粉末。润滑性强，附着性好，但助流性差；具疏水性，用量大会影响片剂崩解，或产生裂片。润滑剂：压片前必须加入的，能增加颗粒（或粉末）流动性，减少颗粒（或粉末）与冲模内摩擦力，具有润滑作用的物料称为润滑剂。常用的润滑剂有硬脂酸镁、滑石粉、聚乙二醇、月桂醇硫酸镁（钠）、微粉硅胶等。崩解剂（A错）：系指能促使片剂在胃肠液中迅速崩解成小粒子而更利于药物溶出的辅料。常用的崩解剂有干燥淀粉、羧甲淀粉钠、低取代羟丙纤维素、泡腾崩解剂、崩解辅助剂等。润湿剂（B错）：本身无黏性，但能润湿并诱发药粉黏性的液体。适用于具有一定黏性的药料制粒压片。常用的湿润剂有水、乙醇等。吸收剂（C错）：适用于原料药（含中间体）中含有较多挥发油、脂肪油或其他液体，而需制片者。常用的吸收剂有淀粉、硫酸钙二水物、磷酸氢钙等。黏合剂（D错）：本身具有黏性，能增加药粉间的黏合作用，以利于制粒和压片的辅料。常用的黏合剂有淀粉浆（糊）、糖浆、胶浆类、微晶纤维素、纤维素衍生物等。淀粉浆（糊）：为最常用的黏合剂。适用于对湿热稳定，而且药物水身不太松散的品种，尤适用于可溶性药物较多的处方。